目前我国县市级卫生行政部门对化妆品的卫生监督主要任务是
A. 普通用途化妆品的初审、生产许可证的发放和生产人员的体检
B. 化妆品生产经营的检查，生产人员的体检
C. 国产化妆品生产审批，生产人员的体检
D. 当地化妆品生产企业许可证的发放，生产人员的体检
E. 经营单位卫生许可证的发放及经营人员的健康体检

正确答案：B。化妆品生产经营的检查，生产人员的体检

解析：本题考查目前我国县市级卫生行政部门对化妆品的卫生监督主要任务。目前我国县市级卫生行政部门对化妆品的卫生监督主要任务是化妆品生产经营的检查，生产人员的体检（B对ACDE错）。